女性，18岁。水肿少尿20天，近2天来出现发热，体温达38度；检查BP120/80mmHg，HB110g/L，尿常规白细胞10～15个/HP，血清白蛋白10g/L，尿蛋白（+++），红细胞0～5个/HP，最可能的诊断是
A. 肾病综合征合并上呼吸道感染
B. 肾病综合征合并泌尿系统感染
C. 感染所致尿改变
D. 急性肾盂肾炎
E. 急性肾炎合并泌尿系统感染

正确答案：B。肾病综合征合并泌尿系统感染

解析：青年女性患者，水肿少尿20天，尿蛋白（+++），红细胞3～5个/HP，血压正常可推断为肾病综合症。该患者近2天来出现发热，体温达38℃，尿常规白细胞10～15个/HP（提示泌尿系统感染）。肾病综合征患者因蛋白质营养不良、免疫功能紊乱及应用糖皮质激素治疗，易并发感染。综上，患者最可能的诊断是肾病综合征合并泌尿系统感染（B对）。患者无上呼吸道感染的症状，可排除肾病综合征合并上呼吸道感染（A错）。感染所致尿改变（C错）、急性肾盂肾炎（D错）多先有较重的全身症状（如发热、寒战等）及泌尿系统症状（尿频、尿急、尿痛等），后再出现检查出尿液异常。急性肾炎合并泌尿系统感染（E错）多会有血尿。